在劳动过程中引起职业紧张的职业因素是
A. 角色特征
B. 工作特征
C. 人际和组织关系
D. 人力资源管理
E. 以上都是

正确答案：E。以上都是